光镜下可见牙龈组织结构为复层鳞状上皮、有上皮钉突、结缔组织常见不同炎症细胞的上皮为
A. 口腔上皮
B. 结合上皮
C. 颊黏膜上皮
D. 龈沟上皮
E. 口腔黏膜上皮

正确答案：D。龈沟上皮

解析：龈沟上皮无角化，有上皮钉突，因为龈沟内食物分解产物和细菌的刺激，故结缔组织内常见不同程度的白细胞浸润。掌握“牙龈”知识点。